妇科得生丸的功能是
A. 益气复脉
B. 益气固表
C. 养血调经
D. 温补气血
E. 解郁调经

正确答案：E。解郁调经

解析：本题考查的是妇科得生丸的功能。妇科得生丸的功能是解郁调经（E对）。妇科得生丸【功能】解郁调经。生脉饮：【功能】益气复脉（A错），养阴生津。固本咳喘片：【功能】益气固表（B错），健脾补肾。四物合剂【功能】调经养血（C错）。十全大补丸：【功能】温补气血（D错）。